赤芍不具有的功效是
A. 清热
B. 凉血
C. 散瘀血
D. 退虚热
E. 清肝火

正确答案：D。退虚热

解析：本题考查的是赤芍的功效。赤芍不具有的功效是退虚热（D错，为本题正确答案）。赤芍：【功效】清热（A对）凉血（B对），散瘀（C对）止痛，清肝火（E对）。退虚热为牡丹皮的功效。牡丹皮：【功效】清热凉血，活血散瘀，退虚热。